患者，男性。35岁。近3个月来经常感到不明原因地紧张、害怕、思虑多，不能控制地胡思乱想，但想法是自己的。患者为此感到苦恼，主动就诊。患者存在的主要症状是
A. 焦虑症状
B. 强迫症状
C. 强制思维
D. 恐惧症状
E. 惊恐发作

正确答案：A。焦虑症状

解析：题干的病历中患者对其存在的症状感到痛苦，主动求治，说明患者的自知力完整。大脑内出现的不能自控的想法是自己的，而非他人的，也不是别人强加于患者的，可以排除强制思维的可能。尽管患者的想法是不能控制的，但并没有明显的抵抗，也就是说患者没有表现出明显的控制这些想法的愿望和动机，同时其脑内的想法变化不定，并不符合强迫观念的特点。虽然患者表现出紧张、害怕的情绪，但其紧张、害怕的情绪并没有客观对象，患者也没有明显的回避行为，不是恐惧的表现。惊恐发作往往是突然出现的紧张、害怕，呈发作性病程，而非持续性，该病历也不符合这一病程特点，可以排除惊恐发作的可能。该患者是没有明确客观对象的担心、紧张、害怕，脑内思虑多、飘忽不定，控制愿望不强烈，病程呈持续性，体现了广泛性焦虑的临床特点。掌握“患者一般心理问题及不同年龄阶段患者心理”知识点。